既可以局部使用，也可以发挥全身疗效，且能避免肝脏首过效应的剂型是
A. 口服溶液剂
B. 颗粒剂
C. 贴剂
D. 片剂
E. 泡腾片剂

正确答案：C。贴剂

解析：本题考查贴剂。既可以局部使用，也可以发挥全身疗效，且能避免肝脏首过效应的剂型是贴剂（C对）。口服溶液剂（A错）、颗粒剂（B错）、片剂（D错）、泡腾片剂（E错）均需经过胃肠道吸收，不能避免肝脏首过效应。